省人民政府病毒、病菌丢失上报时间是
A. 1小时
B. 1.5小时
C. 2小时
D. 12小时
E. 24小时

正确答案：A。1小时

解析：根据《突发公共卫生事件应急条例》规定，发生传染病菌种、毒种丢失，省、自治区、直辖市人民政应当在接到报告1小时内（A对），向国务院卫生行政部门报告。